以下关于骨膜上和黏膜下浸润麻醉的相关叙述中，正确的是
A. 一般多在上颌牙槽突或下颌前牙区的牙槽突应用浸润麻醉
B. 有些部位的牙槽骨骨质比较菲薄，并且疏松多孔，局麻药液容易渗透
C. 黏膜下浸润是将麻醉药注射到黏膜下组织，而并不要求到达骨膜下
D. 骨膜上浸润是将麻醉药注射到牙根尖部位的骨膜外面
E. 以上说法均正确

正确答案：E。以上说法均正确

解析：骨膜上和黏膜下浸润麻醉：在牙及牙槽外科手术中，一般多在上颌牙槽突或下颌前牙区的牙槽突应用浸润麻醉，因为这些部位的牙槽骨骨质比较菲薄，并且疏松多孔，局麻药液容易渗透入众多小孔，进入颌骨，麻醉牙神经丛。常用的浸润麻醉方法有：①骨膜上浸润是将麻醉药注射到牙根尖部位的骨膜外面；②黏膜下浸润是将麻醉药注射到黏膜下组织，而并不要求到达骨膜下。掌握“颌面部常用局麻法及牙拔除的麻醉选择”知识点。